女，40岁，既往健康。5天前无明确诱因出现发热、恶心、食欲不振伴尿黄，明显乏力。实验室检查：ALT740u/L，TBil58umol/L。该患者诊断应考虑为
A. 淤胆型肝炎
B. 急性黄疸型肝炎
C. 急性重型肝炎
D. 亚急性重型肝炎
E. 急性无黄疽型肝炎

正确答案：B。急性黄疸型肝炎

解析：中年女性患者，既往健康，突发无明确诱因出现发热恶心食欲不振伴尿黄，明显乏力，实验室检查ALT740u/L（正常参考值0～40U/L），TBil58umol/L（正常参考值3.4～17.1μmol/L），提示肝功能受损，根据患者的既往史、临场表现和实验室检查，该患者诊断应考虑为急性黄疸型肝炎（B对）。淤胆型肝炎（A错）又称毛细胆管炎型肝炎，是以肝内淤胆为主要表现的一种特殊临床类型，有梗阻性黄疸临床表现，皮肤瘙痒、粪便颜色变浅。肝大，消化道症状较轻，ALT、AST升高不明显。急性重型肝炎（C错）又称爆发性肝炎，特征是起病急，发病2周内出现Ⅱ度以上肝性脑病为特征的肝衰竭症候群（极度乏力；严重的消化道症状，神经、精神症状，有明显出血倾向，凝血酶原时间显著延长及凝血酶原活动度小于40%；黄疸进行性加深，胆红素每天上升≥17.1umol/L或大于正常值10倍）。亚急性重型肝炎（D错）又称亚急性肝坏死，起病较急，发病15-26周内出现肝衰竭症候群。急性无黄疽型肝炎（E错）通常起病缓慢，症状较轻，主要表现为全身乏力、食欲下降、恶性、腹胀，但无黄疸相关的表现。